男，63岁。咳嗽、痰中带血丝半年余。吸烟40余年。胸部X线片示右上肺近肺门处肿块影。为明确病理诊断，首选的检查是
A. 开胸活检
B. 胸腔镜活检
C. 纵膈镜活检
D. 经胸壁肺穿刺活检
E. 支气管镜活检

正确答案：E。支气管镜活检

解析：老年男性患者，有长期吸烟史，咳嗽、痰中带血，胸部X线片示右上肺近肺门处肿块，结合患者病史、临床表现和影像学检查，该患者最可能的诊断为右侧中央型肺癌。患者肺部肿块近肺门，为明确病理诊断，首选的检查是支气管镜活检（E对），该方法操作简便、创伤较小，不仅可在直视下观察气管和支气管中的病变，还可钳取病变组织做病理检查，明确诊断。开胸活检（A错）一般尽在肺癌手术时同时进行。胸腔镜活检（B错）创伤较大，一般在其他检查未能取得病理诊断且临床高度怀疑肺癌时考虑进行。纵膈镜活检（C错）主要用于明确肺癌有无纵隔淋巴结的转移。经胸壁肺穿刺活检（D错）主要用于周围型肺癌的诊断。